基底细胞活跃，偶见黑色素细胞，或含有黑色素颗粒的上皮为
A. 牙龈上皮
B. 龈沟上皮
C. 结合上皮
D. 龈谷
E. 附着龈

正确答案：A。牙龈上皮

解析：牙龈上皮为复层鳞状上皮，基底细胞生长活跃，偶见黑色素细胞，或含有黑色素颗粒，所以牙龈有时出现黑色斑块。掌握“牙龈”知识点。